生物医学模式的局限性在于
A. 对医学的发展起到了促进作用
B. 确立了基因理论
C. 发展了基因技术
D. 忽视了人的社会性
E. 抗菌药物的应用

正确答案：D。忽视了人的社会性